处方直接写药名，需调配醋炙品的是
A. 僵蚕
B. 干漆
C. 延胡索
D. 吴茱萸
E. 王不留行

正确答案：C。延胡索

解析：本题考查的是饮片的处方应付。处方直接写药名，需调配醋炙品的是延胡索（C对）。处方直接写药名（或炒或炙），需调配醋炙品，如延胡索等。处方直接写药名（或炒），需调配麸炒品，如僵蚕（A错）、白术、枳壳等。处方直接写药名（或炒或炭），需调配炭制品，如干漆（B错）、炮姜、地榆、侧柏叶、蒲黄等。处方直接写药名（或制），需调配炮制品，如草乌（水制）、川乌（水制）、天南星（矾制）、附子（炮制）、吴茱萸（D错）（甘草水制）、远志（甘草水制去心）、厚朴（姜制）、何首乌等。处方直接写药名（或炒），需调配清炒品，如紫苏子、莱菔子、谷芽、麦芽、王不留行（E错）、酸枣仁、蔓荆子、苍耳子、牛蒡子、白芥子等。